对判断肝硬化患者预后意义不大的指标是
A. 腹水
B. 白蛋白
C. 血清电解质
D. 凝血酶原时间
E. 肝性脑病

正确答案：C。血清电解质

解析：临床上，通常用肝功Child-Pugh评分对肝硬化患者预后进行评估。观测指标包括腹水（A错）、胆红素、白蛋白（B错）、PT（凝血酶原时间）（D错）、肝性脑病（E错）：腹水是肝功能减退和门静脉高压的共同结果（P407）；胆红素可反映肝细胞损伤或胆汁淤积；白蛋白仅由肝细胞合成，绝大部分凝血因子在肝脏合成，二者可反映肝脏合成功能；肝性脑病是肝硬化最严重的并发症。血清电解质（C对）仅可反映机体内环境的变化，对于判断肝硬化患者预后的意义不大。